氟康唑质量标准中，含量测定采用的方法是
A. 非水溶液滴定法
B. 旋光度测定法
C. 气相色谱法
D. 氧瓶燃烧-比色法
E. 红外分光光度法

正确答案：A。非水溶液滴定法

解析：本题考查氟康唑的含量测定方法。氟康唑的含量测定采用非水溶液滴定法（A对）。取本品约0.1g，精密称定，加冰醋酸50ml溶解后，照电位滴定法（2010年版药典二部附录ⅦA），用高氯酸滴定液（0.1mol/L）滴定，并将滴定的结果用空白试验校正。每1ml高氯酸滴定液（0.1mol/L）相当于15.31mg的C₁₃H₁₂F₂N₆O。